在口腔修复前肯定需要拔除的牙是
A. 牙槽骨吸收达根长的1/3，松动Ⅰ°
B. 牙槽骨吸收达根长的1/2，松动Ⅰ°
C. 牙槽骨吸收达根长的1/3，松动Ⅱ°
D. 牙槽骨吸收达根长的1/2，松动Ⅱ°
E. 牙槽骨吸收达根长的2/3，松动Ⅲ°

正确答案：E。牙槽骨吸收达根长的2/3，松动Ⅲ°

解析：本题考查余留牙的保留与拔除。口腔修复前需对松动牙进行相应处理，一般来说，对于牙槽骨吸收达根长的2/3，松动Ⅲ°（E对）者需要拔除。而牙槽骨吸收不足2/3或松动Ⅲ°以下者应经有效治疗后，如龈下刮治术、根面平整术等，应尽量予以保存，如牙槽骨吸收达根长的1/3，松动Ⅰ°（A错）；牙槽骨吸收达根长的1/2，松动Ⅰ°（B错）；牙槽骨吸收达根长的1/3，松动Ⅱ°（C错）；牙槽骨吸收达根长的1/2，松动Ⅱ°（D错）。